外侧半月板
A. 表面衬覆着滑膜
B. 外侧缘与腓侧副韧带紧密相连
C. 伸膝时滑向前方
D. 屈膝时滑向前方
E. 外缘薄，内缘厚

正确答案：C。伸膝时滑向前方

解析：内侧半月板外缘与关节囊及胫侧副韧带（B错）紧密相连，外侧半月板外缘与关节囊相连。膝关节滑膜包裹了除去关节软骨和半月板以外（A错）的所有结构。半月板参与膝盖的运动，屈膝时,半月板滑向后方（D错）,伸膝时滑向前方（C对），半屈膝旋转小腿时,一个半月板滑向前,另一个滑向后。半月板属于关节盘，外缘厚，内缘薄（E错）。